女，25岁。乏力3个月。查体BP170/105mmHg。化验检查Hb84g/L，尿常规：蛋白（++），颗粒管型2～3/低倍视野，血BUN12.3mmol/L，Scr276.8μmol/L。对该患者不应该采取的措施是
A. 低磷饮食
B. 控制血压
C. 根据尿量适当限水
D. 高蛋白饮食
E. 低钠饮食

正确答案：D。高蛋白饮食

解析：青年女性患者，乏力3个月，查体：BP170/105mmHg（2级高血压）。实验室检查： Hb84g/L（中度贫血），尿常规蛋白（++），颗粒管型2～3/低倍视野，血BUN 12.3mmol/L（正常值2.86～7.14mmol/L，提示肾功能受损），Scr 276.8μmol/L【正常值（女）70～108μmol/L，提示肾功能失代偿进入肾衰前期】。综上，考虑患者慢性肾炎可能性大。慢性肾炎患者的治疗措施中最主要的是控制高血压（B对）和减少尿蛋白，从而防止肾功能进一步恶化。肾炎导致的高血压多为容量依赖性，因此，应根据尿量适当限水（C对）及采取低钠饮食（E对）。且患者应采用低蛋白饮食（D错，为本题正确答案）以免加重肾负担。因肾炎患者可致水电解质紊乱致高血磷低血钙，可致肾性骨病的形成，因此，应采用低磷饮食（A对）。